记载在药物质量标准“性状”下的内容有
A. 外观
B. 溶解度
C. 有关物质
D. 含量测定
E. 物理常数

正确答案：A、B、E。外观；溶解度；物理常数

解析：本题考查《中国药典》基本要求。《中国药典》性状项下记载药品的外观（A对）、臭（味）、溶解度（B对）以及物理常数（E对）等。